女性30岁，主诉下唇中份疼痛2天，进食刺激性食物可加剧疼痛；口腔检查：相对左下1唇侧黏膜见一直径1cm溃疡，上覆假膜，溃疡基底充血，触痛明显。主诉相似病病史约3年，每年发作4～6次。溃疡可自行愈合。拟诊
A. 盘状红斑狼疮
B. 疱疹样口炎
C. 轻型口疮
D. 重型口疮
E. 多形红斑

正确答案：C。轻型口疮

解析：本题考查复发性阿氟他溃疡的临床表现。女性30岁，主诉下唇中份疼痛2天，进食刺激性食物可加剧疼痛；口腔检查：相对左下1唇侧黏膜见一直径1cm溃疡，上覆假膜，溃疡基底充血，触痛明显。主诉相似病病史约3年，每年发作4～6次。溃疡可自行愈合。拟诊轻型口疮（C对）。根据患者发病情况（相似病史每年发作4～6次）以及局部表现可诊断为复发性轻型阿弗他溃疡（轻型口疮），多数复发性阿弗他溃疡患者发病时均为此型，该型是反复发作的圆形或椭圆形溃疡，具有黄红凹痛的特征，即溃疡表面覆盖黄色假膜、周围有红晕带、中央有凹陷、疼痛明显。盘状红斑狼疮（A错）黏膜病损特点为圆形或椭圆形红斑糜烂凹下似盘状，边缘稍隆，周围有红晕或可见毛细血管扩张，红晕周围有呈放射状排列的细短白纹。疱疹样口炎（B错）的损害表现为有多个成簇的疱，而该患者未出现疱。重型口疮（D错）的溃疡大而深，似弹坑状（为典型表现），直径多大于10mm。多形性红斑（E错）口腔黏膜广泛充血、发红、水肿，并有大面积糜烂，皮肤可见多种病损如红斑、丘疹，与患者的病变特点不符。